饮片呈半环形或类月牙形薄片，周边暗红棕色至暗棕色，具不规则沟纹及皱纹，切面棕红色，质坚硬，气微，味酸涩的中药材是
A. 木瓜
B. 枳壳
C. 厚朴
D. 肉桂
E. 秦皮

正确答案：A。木瓜

解析：本题考查的是木瓜饮片的性状鉴别。饮片呈半环形或类月牙形薄片，周边暗红棕色至暗棕色，具不规则沟纹及皱纹，切面棕红色，质坚硬，气微，味酸涩的中药材是木瓜（A对）。木瓜：【性状鉴别】饮片呈类月牙形薄片。外表面紫红色或棕红色，有不规则的深皱纹。切面棕红色。气微清香，味酸。枳壳（B错）：【性状鉴别】饮片呈不规则弧状条形薄片。切面外果皮棕褐色至褐色，中果皮黄白色至黄棕色，近外缘有1～2列点状油室，内侧有的有少量紫褐色瓤囊。厚朴（C错）：【性状鉴别】饮片呈弯曲的丝条状或单、双卷筒状。外表面灰褐色，有时可见椭圆形皮孔或纵皱纹。内表面紫棕色或深紫褐色，较平滑，具细密纵纹，划之显油痕。切面颗粒性，有油性，有的可见小亮星。气香，味辛辣、微苦。肉桂（D错）：【性状鉴别】饮片呈槽状或卷筒状。外表面灰棕色，稍粗糙，有不规则的细皱纹及横向突起的皮孔，有的可见灰白色的斑纹；内表面红棕色，较平坦，有细纵纹，划之显油痕。质硬而脆，易折断，断面不平坦，外层棕色而较粗糙，内层红棕色而油润，两层中间有1条黄棕色的线纹。气香浓烈，味甜、辣。秦皮（E错）：【性状鉴别】饮片呈长短不一的丝条状。外表面灰白色、灰棕色或黑棕色。内表面黄白色或棕色，平滑。切面纤维性。质硬。气微，味苦。